间叶组织分化的肿瘤是
A. 颈部淋巴管瘤
B. 皮肤恶性黑色素瘤
C. 乳腺髓样癌
D. 子宫绒毛膜癌
E. 睾丸精原细胞瘤

正确答案：A。颈部淋巴管瘤

解析：颈部淋巴管瘤（A对）为间叶组织来源的肿瘤。乳腺髓样癌（C错）是上皮组织分化的肿瘤。皮肤恶性黑色素瘤（B错）为神经外胚叶肿瘤（P117）；子宫绒毛膜癌（C错）是源自妊娠绒毛滋养层上皮的高度侵袭性恶性肿瘤，少数可发生于性腺或其他组织的多潜能细胞（P287-P288）。睾丸精原细胞瘤（D错）为生殖细胞肿瘤。